热胜作痒的主要症状是
A. 浸淫四窜，黄水淋漓
B. 走窜无定，遍体作痒
C. 皮肤瘾疹，焮红灼热作痒
D. 瘙痒剧烈，最易传染
E. 脱屑作痒，皮肤干燥

正确答案：C。皮肤瘾疹，焮红灼热作痒

解析：中医认为‘热微则痒’，即痒是因风、湿、热、虫之邪客于皮肤肌表，引起皮肉间气血不和，郁而生微热所致，或由于血虚风燥阻于皮肤，肌肤失于濡养，内生虚热而发。皮肤瘾疹，红灼热作痒，是热胜作痒的临床表现（C对）。浸淫四窜，黄水淋漓，是湿盛作痒的临床表现（A错）。走窜无定，遍体作痒，是风胜作痒的临床表现（B错）。瘙痒剧烈，最易传染是虫淫作痒的临床表现（D错）。脱屑作痒，皮肤干燥是血虚作痒的临床表现（E错）。